扶正与祛邪同时使用的原则是
A. 扶正不留邪，祛邪不伤正
B. 先治其表，后治其里
C. 先治里其，后治其表
D. 扶正为主，祛邪为辅
E. 祛邪为主，扶正为辅

正确答案：A、D、E。扶正不留邪，祛邪不伤正；扶正为主，祛邪为辅；祛邪为主，扶正为辅

解析：本题考查的是用扶正祛邪的运用。扶正与祛邪同时使用的原则是扶正不留邪，祛邪不伤正（A对）、扶正为主，祛邪为辅（D对）与祛邪为主，扶正为辅（E对）。扶正与祛邪兼用：扶正与祛邪兼用又称“攻补兼施”，适用于正虚邪实病证，两者同时兼用，则扶正不留邪，祛邪又不会伤正。在具体应用时，还要分清以正虚为主，还是以邪实为主。正虚较急重的，应以扶正为主，兼顾祛邪；而邪实较急重的，则以祛邪为主，兼顾扶正。